急性排斥反应多发生于同种异基因组织移植术后
A. 数分钟至24小时
B. 数天至2周左右
C. 1个月内
D. 数月
E. 数年

正确答案：C。1个月内

解析：超急性排斥反应是在移植器官与受者血管接通后数分钟至24小时内发生的排斥反应；急性排斥反应一般在移植后的数天至2周左右出现，多发于术后1个月内；慢性排斥反应是发生在移植后数周、数月至数年的排斥反应。掌握“移植免疫”知识点。